士的宁的致死量为
A. 30mg
B. 5～10mg
C. 2～4mg
D. 0.5mg
E. 0.2mg

正确答案：A。30mg